患儿，5周岁。两周前曾患上感，目前不规则发热，易疲倦，脸色略苍白。查体发现：心率增快，心尖部第一心音减弱，并可闻及早搏，心电检查：P-R间期延长，ST段下移，实验室检查：C反应蛋白增高。哪项检查可以帮助确诊
A. 心脏X线检查
B. 肌酸磷酸激酶
C. 血沉
D. 谷草转氨酶
E. 抗透明质酸钠

正确答案：B。肌酸磷酸激酶

解析：患儿有上呼吸道感染史，及心脏功能不全的症状，首先应该考虑病毒性心肌炎。抗透明质酸钠（E对）。X线检查轻型病例心影一般在正常范围，伴心力衰竭或心包积液者可见心影扩大，少数病例胸腔可见少量积液，无法确诊病例（A错）。病毒性心肌炎的急性期清谷草转氨酶（SGOT）、乳酸脱氢酶（LDH）、α-羟丁酸脱氢酶（α-HBDH）、肌酸磷酸激酶（CK）及同工酶（CK-MB）在均可升高（B错）。血沉对于急性炎症、活动性结核、风湿病活动期、组织严重破坏、贫血、恶性肿瘤等的确诊均有辅助作用。谷草转氨酶（AST）主要分布在心肌，其次是肝脏、骨骼肌和肾脏等组织中。正常时血清中的AST含量较低，但相应细胞受损时，细胞膜通透性增加，胞浆内的AST释放入血，故其血清浓度可升高，临床一般常作为心肌梗死和心肌炎的辅助检查（D错）。